阿尔茨海默病的早期症状主要为
A. 性格改变
B. 记忆减退
C. 情绪急躁易怒
D. 幻觉
E. 妄想

正确答案：B。记忆减退

解析：阿尔茨海默病（AD）是一组病因未明的原发性退行性脑变性疾病，多起病于老年期，潜隐起病，病程缓慢且不可逆，记忆力减退常为阿尔茨海默病的早期及最主要的临床症状（B对）。AD早期阶段可出现情绪不稳、情绪急躁易怒（C错），但不是最主要的早期症状。AD中度阶段可出现幻觉和妄想（DE错），其中以被窃妄想最常见，其次是嫉妒妄想。